患者心烦口渴，口舌生疮，小便赤涩，尿道灼痛，舌尖红赤，苔黄脉数。此属
A. 心火亢盛证
B. 肝火上炎证
C. 小肠实热证
D. 膀胱湿热证
E. 肠燥津亏证

正确答案：C。小肠实热证

解析：小肠实热证（亦称心火下移证，习称为心移热于小肠），是指小肠里热炽盛所表现的证候，多由心热下移所致，临床表现为心烦口渴，口舌生疮，小使赤涩，尿道灼痛，尿血，舌红苔黄，脉数，本证以心火热炽及小便赤涩灼痛为辨证要点，本题临床表现与之相符，结合辨证要点，故其证型为小肠实热证，心与小肠相表里，小肠有分清泌浊的功能，使水液入于膀胱，心热下移小肠，故小便赤涩，尿道灼痛；心火内炽，热扰心神，则心烦；津为热灼则口渴；心火上炎则口舌生疮；舌红苔黄，脉数为里热之征（C对）。“心火亢盛证，临床表现为发热，口渴，心烦，失眠，便秘，尿黄，面红，舌尖红绛，苔黄，脉数有力。甚或口舌生疮、溃烂疼痛；或见小便短赤、灼热涩痛；或见吐血、衄血；或见狂躁谵语、神识不清”，若兼小便赤、涩、灼、痛者，称心火下移证，即小肠实热证（A错）。“肝火炽盛证，临床表现为头晕胀痛，痛势剧烈，面红目赤，口苦口干，急躁易怒，耳鸣如潮，甚或突发耳聋，失眠多梦，或胁肋灼痛，吐血、衄血，小便短黄，大便秘结，舌红苔黄，脉弦数”，本题临床表现与之不符(B错)。“膀胱湿热证，临床表现为小便频数、急迫、短黄，排尿灼热、涩痛，或小便浑浊、尿血、有砂石，或腰部、小腹胀痛，发热，口渴，舌红，苔黄腻，脉滑数或濡数”，本证虽可出现小便赤色，尿道灼痛，但无心烦、口舌生疮等心经病证，不符合题意（D错）。“肠燥津亏证，临床表现为大便干燥如羊屎，艰涩难下，数日一行，腹胀作痛，左少腹或可触及包块，口干，或口臭，或头晕，舌红少津，苔黄燥，脉细涩”，本题临床表现与之不符（E错）。